女，60岁。性交接触性出血4月余，妇科检查：外阴阴道未见异常，宫颈肥大糜烂质脆，子宫及双附件未见异常。病理检查报告宫颈鳞状细胞异型性增生，占宫颈上皮全层2/3以上，伴人乳头瘤病毒感染。此例的合适治疗为
A. 微波治疗
B. 激光治疗
C. 随诊观察
D. 局部药物治疗
E. 全子宫切除治疗

正确答案：E。全子宫切除治疗

解析：患者为老年女性，接触性出血数月余，妇检：外阴阴道未见异常，宫颈肥大糜烂质脆，子宫及双附件未见异常。病理检查报告宫颈鳞状细胞异型性增生，占宫颈上皮全层2/3以上，伴人乳头瘤病毒感染，应诊断为CINⅢ。患者年龄较大、无生育要求，合适的治疗为全子宫切除术（E对）。微波治疗（A错）、激光治疗（B错）、随诊观察（C错）适用于CINⅠ的患者（P303）。局部药物治疗（D错）对CIN无效。